在某地进行的吸烟与肺癌关系的研究显示，该地人群肺癌年死亡率为0.56‰，吸烟与不吸烟者的肺癌年死亡率分别为0.96‰和0.07‰。上述研究的相对危险度（RR）为
A. 0.927
B. 0.07
C. 13.71
D. 1.71
E. 8

正确答案：C。13.71